下列各项，不属于瘿痈特征的是
A. 颈中两侧结块
B. 皮色不变
C. 微有灼热
D. 疼痛牵引至耳后枕部
E. 容易化脓

正确答案：E。容易化脓

解析：瘿痈多因风温、风火客于肺胃，内有肝郁胃热，积热上壅，挟痰蕴结，以致气血凝滞，郁而化热发为本病。气血凝滞于颈部故颈中两侧有结块。瘿痈为气血凝滞，郁而化热所致，热多致皮色变红。气血凝滞，郁而化热故微有灼热。瘿痈的气滞痰凝者疼痛可牵引至耳后枕部，活动或吞咽时加重（ABCD对）。瘿痈一般不易成脓，与之需要鉴别的是易成脓破溃的颈痈（E错，为本题正确答案）。